夏季下列哪项农业劳动引起中暑的可能性相对较小
A. 旱地作业
B. 水田作业
C. 密植高杆作物的大田劳动
D. 农业机械驾驶室内
E. 以上均可

正确答案：B。水田作业